木香的主产地是
A. 甘肃
B. 河南
C. 四川
D. 云南
E. 吉林

正确答案：D。云南

解析：本题考查的是木香的产地。木香的主产地是云南（D对）。木香：【产地】主产于云南。四川、西藏亦产。为栽培品。西北药：主产地“丝绸之路”的起点西安以西的广大地区（陕、甘（A错）、宁、青、新及内蒙古西部）。如大黄、当归、秦艽、秦皮、羌活、枸杞子、银柴胡、党参、紫草、阿魏等。怀药：主产地河南（B错）。如著名的“四大怀药”——地黄、牛膝、山药、菊花；以及天花粉、瓜蒌、白芷、辛夷、红花、金银花、山茱萸等。主产地四川（C错）、西藏等。如川贝母、川芎、黄连、川乌、附子、麦冬、丹参、干姜、白芷、天麻、川牛膝、川楝子、川楝皮、川续断、花椒、黄柏、厚朴、金钱草、五倍子、冬虫夏草、麝香等。关药：主产地山海关以北、东北三省（E错）及内蒙古东部。如人参、鹿茸、细辛、辽五味子、防风、关黄柏、龙胆、平贝母、刺五加、升麻、桔梗、哈蟆油、甘草、麻黄、黄芪、赤芍、苍术等。